执业药师参与健康教育活动的内容有
A. 开展健康知识讲座
B. 提供科普教育材料
C. 提供药学知识咨询
D. 宣传和销售保健品
E. 讲授自我保健知识

正确答案：A、B、C、E。开展健康知识讲座；提供科普教育材料；提供药学知识咨询；讲授自我保健知识

解析：本题考查的是执业药师的要求。执业药师参与健康教育活动的内容有开展健康知识讲座（A对）、提供科普教育材料（B对）、提供药学知识咨询（C对）、讲授自我保健知识（E对）。